与有机磷农药中毒机理类似的是
A. 拟除虫菊酯类
B. 氨基甲酸酯类
C. 有机氯类
D. 有机氟类

正确答案：B。氨基甲酸酯类

解析：本题考查有机磷农药中毒机制。有机磷农药急性毒作用的主要机制是抑制胆碱酯酶活性，使之失去分解乙酰胆碱的能力，导致乙酰胆碱在体内聚集，而产生相应的功能紊乱。氨基甲酸酯类农药的急性毒作用机制是直接抑制体内的乙酰胆碱酯酶（B对）。拟除虫菊酯类（A错）农药其作用机制是扰乱昆虫神经的正常生理，使之由兴奋、痉挛到麻痹而死亡。有机氯和有机氟的中毒机理教材未涉及（CD错）。